患者男，50岁。因失眠多梦半月余就诊。现不寐，入睡困难，心烦口苦，头重如裹，胸闷，舌红苔黄腻，脉滑数。其治法是
A. 滋阴清热，镇心安神
B. 疏肝泻热，佐以安神
C. 补养心脾，以生气血
D. 化痰清热，和中安神
E. 益气镇惊，安神定志

正确答案：D。化痰清热，和中安神

解析：本题不寐患者因宿食停滞，土壅木郁，肝胆不疏，因郁致热，生痰生热，痰热上扰，故不寐心烦，口苦目眩；痰热郁阻，气机不畅，胃失和降，则头重，胸脘满闷；痰湿蕴结大肠则大便不爽；舌红，苔黄腻，脉滑数，均是痰热之象，应当清化痰热，和中安神（D对），方用黄连温胆汤加减。心脾两虚证，治以补养心脾，以生气血（C错），用归脾汤。肝郁化火证，治以清肝泻火，佐以安神（B错）用龙胆泻肝汤。阴虚火旺证治宜滋阴清热，镇心安神（A错）用黄连阿胶汤。心胆气虚治宜益气镇惊，安神定志（D错）用安神定志丸。